协调性子宫收缩乏力时应采用的治疗是
A. 肌肉注射哌替啶
B. 静脉滴注缩宫素
C. 人工破膜
D. 剖宫产术
E. 阴道内应用前列腺素栓剂

正确答案：B。静脉滴注缩宫素

解析：静脉滴注缩宫素（B对）适用于协调性宫缩乏力。肌肉注射哌替啶（P189）（A错）主要用于时不协调性子宫收缩乏力恢复为协调性。人工破膜（P189）（C错）主要用于宫口扩张≥3cm、无头盆不称、胎头已衔接而产程延缓者。剖宫产术（D错）用于不能通过阴道正常分娩的患者。阴道内应用前列腺素栓（E错）用于早期引产。